提出“雷公炮炙十七法”的是
A. 雷斅
B. 张仲岩
C. 李时珍
D. 缪希雍
E. 陈嘉谟

正确答案：D。缪希雍

解析：本题考查的是“雷公炮炙十七法”。提出“雷公炮炙十七法”的是缪希雍（D对）。明代缪希雍在《炮制大法》卷首将当时的炮制方法归纳为“雷公炮炙十七法”。